信度是指
A. 测量工具的稳定性和可靠性
B. 测量工具的有效性
C. 测量工具的准则
D. 与研究目的的吻合度
E. 以上都是

正确答案：A。测量工具的稳定性和可靠性